在反相高效液相色谱法中，常用的固定相是
A. 硅胶
B. 氧化铝
C. 十八烷基硅烷键合硅胶
D. 甲醇
E. 水

正确答案：C。十八烷基硅烷键合硅胶